男孩，8岁。剧烈运动后胸闷，气短1个月。查体：心前区未触及震颤，胸骨左缘2～3肋间闻及3/6级缩期喷射性杂音，P₂增强，固定分裂。心脏杂音形成的最直接原因是
A. 肺动脉瓣明显狭窄
B. 右心压力负荷增加
C. 经肺动脉瓣血流量增多
D. 主动脉瓣相对狭窄
E. 血液经房间隔缺损自左房流入右房

正确答案：C。经肺动脉瓣血流量增多

解析：根据患儿的杂音特点：胸骨左缘2-3肋间闻及3/6级缩期喷射性杂音、P₂增强，固定分裂，应诊断为房间隔缺损。房间隔缺损可引起右心室肥大。由于右心室肥大，大量的血流通过正常肺动脉瓣时（形成相对狭窄）可与胸骨左缘第二肋间闻及2～3级喷射性收缩期杂音，这是房间隔缺损典型的杂音。由此可知，肺动脉瓣是相对狭窄而不是明显的狭窄（C对AD错）。血液经房间隔缺损自左房流入右房的描述本身是正确的，但不是杂音产生的最直接的原因（E错），并由此可知右心房的容量负荷增加（B错）。